最常见的口腔颌面部感染是
A. 牙源性
B. 血源性
C. 损伤性
D. 腺源性
E. 医源性

正确答案：A。牙源性

解析：本题考查面颈部淋巴结炎。病原菌通过病变牙或牙周组织进入体内发生感染者，称牙源性感染。牙与颌骨直接相连，牙体及牙周感染可向根尖、牙槽骨、颌骨以及颌面部蜂窝组织间隙扩散。由于龋病、牙周病、智牙冠周炎均为临床常见病，故牙源性（A对）途径是口腔颌面部感染的主要途径。